下列牙根拔除基本操作步骤，恰当的是
A. 根钳拔除法适用于高位残根
B. 如牙根断面是斜面，根挺应从斜面较高的一侧插入
C. 牙挺取根法适用于根的折断部位比较低，根钳无法夹住时
D. 牙挺取根法支点应为牙槽间隔，或腭侧骨板
E. 以上说法均正确

正确答案：E。以上说法均正确

解析：根钳拔除法适用于高位残根，颈部折断的断根或虽折断部位低于牙槽嵴，但在去除少许牙槽骨壁后，仍能用根钳夹住的断根。牙挺取根法适用于根的折断部位比较低，根钳无法夹住时，应使用牙挺将其挺出。应选用能进入牙槽窝并能达一定深度的牙挺，挺刃的大小、宽窄应与牙根相适应。其支点应为牙槽间隔，或腭侧骨板。如牙根断面是斜面，根挺应从斜面较高的一侧插入。掌握“牙根拔除术”知识点。